磨牙铸造（牙合）支托的宽度和长度为
A. 宽度为颊舌径的1/3，长度为近远中径的1/4
B. 宽度为颊舌径的1/4，长度为近远中径的1/4
C. 宽度为颊舌径的1/4，长度为近远中径的1/3
D. 宽度为颊舌径的1/3，长度为近远中径的1/3
E. 宽度为颊舌径的1/2，长度为近远中径的1/2

正确答案：A。宽度为颊舌径的1/3，长度为近远中径的1/4

解析：本题考查（牙合）支托的形态。磨牙铸造（牙合）支托的宽度为磨牙颊舌径的1/3（A对）或前磨牙的1/2，厚度为1-1.5mm左右，长度一般为磨牙的1/4（A对）或前磨牙的1/3近远中径。若（牙合）支托过宽过长，则需要磨除过多的牙体组织，可能造成牙体敏感，且（牙合）支托过大还会影响咬合。若（牙合）支托过窄过短，则稳定性不好，无法起到支承传递（牙合）力的作用，义齿受力时会向龈向下沉，还可能导致食物嵌塞。